用于制备静脉给药的中药注射剂，有效部位的含量应不低于总固体量的
A. 0.25
B. 0.5
C. 0.7
D. 0.85
E. 90%以上

正确答案：D。0.85